男性，58岁。6个月前急性心肌梗死，心电图V₁～V₅导联ST段持续抬高3mm，近3个月偶于快跑时出现胸闷，持续1小时。体检：心界向左侧扩大，心尖搏动弥散。该患者最可能的诊断是
A. 急性心包炎
B. 心室膨胀瘤
C. 变异型心绞痛
D. 梗死后心绞痛
E. 急性心肌梗死

正确答案：B。心室膨胀瘤

解析：患者为中老年男性，58岁，有急性心肌梗死病史，心电图V₁～V₅导联ST段持续抬高3mm，体检：心界向左侧扩大，心尖搏动弥散，该患者最可能的诊断是心室膨胀瘤（B对）。急性心包炎（A错）多有与呼吸运动相关的心前区疼痛，在胸骨左缘第3、4肋间可闻及特征性的心包摩擦音。变异型心绞痛（C错）多在夜间静息时发作胸痛，可自行缓解，仅出现一过性的ST段抬高。梗死后心绞痛（D错）属于不稳定型心绞痛，心电图多出现ST段压低，并非持续抬高。急性心肌梗死（E错）可出现持续性胸痛和特征性的ST段弓背向上抬高，但很少出现心界向左侧扩大，心尖搏动弥散等体征。